某女，45岁。症见烘热汗出、心烦易怒、少寐健忘、头晕耳鸣、口渴咽干、四肢酸楚，宜选用的中成药是
A. 大黄䗪虫丸
B. 七制香附丸
C. 少腹逐瘀丸
D. 坤宝丸
E. 八珍益母丸

正确答案：D。坤宝丸

解析：本题考查的是坤宝丸的主治。症见烘热汗出、心烦易怒、少寐健忘、头晕耳鸣、口渴咽干、四肢酸楚，宜选用的中成药是坤宝丸（D对）。坤宝丸：【主治】肝肾阴虚所致的绝经前后诸证，症见烘热汗出、心烦易怒、少寐健忘、头晕耳鸣、口渴咽干、四肢酸楚；更年期综合征见上述证候者。大黄䗪虫丸（A错）：【主治】瘀血内停所致的癥瘕、闭经，症见腹部肿块、肌肤甲错、面色黯黑、潮热羸瘦、经闭不行。七制香附丸（B错）：【主治】气滞血虚所致的痛经、月经量少、闭经，症见胸胁胀痛、经行量少、行经小腹胀痛、经前双乳胀痛、经水数月不行。少腹逐瘀丸（C错）：【主治】寒凝血瘀所致的月经后期、痛经、产后腹痛，症见行经后错、经行小腹冷痛、经血紫黯、有血块、产后小腹疼痛喜热、拒按。八珍益母丸（E错）：【主治】气血两虚兼有血瘀所致的月经不调，症见月经周期错后、行经量少、淋漓不净、精神不振、肢体乏力。